应用芫荽治疗麻疹，宜采用
A. 熏洗法
B. 气雾吸入法
C. 涂敷法
D. 敷贴法
E. 热熨法

正确答案：A。熏洗法

解析：熏洗使人体皮肤面积与接触药物面积大，用芫荽熏洗，对麻疹可有透疹之效（A对）。气雾吸入法常用于治疗肺系疾病（B错）。涂敷法是将新鲜的中草药捣烂，或用药物研末加入水或醋调匀后，涂敷于体表的一种治疗方式，如贴敷腮部，脚底等（C错）。敷贴法是将药物制成软膏、药饼，或研粉撒于普通膏药上，敷贴于局部的一种外治法，常用于治疗哮喘或腹泻等（D错）。热熨法是将药炒热后，用布包裹以熨肌表的一种外治法，常用于腹痛、癃闭等疾病（E错）。